干扰肿瘤细胞转录过程和阻止RNA合成的抗肿瘤药是
A. 多柔比星
B. 氟尿嘧啶
C. 伊立替康
D. 多西他赛
E. 门冬酰胺酶

正确答案：A。多柔比星

解析：本题考查多柔比星。干扰肿瘤细胞转录过程和阻止RNA合成的抗肿瘤药是多柔比星（A对）。药物可嵌入DNA碱基对之间，干扰转录过程，阻止mRNA的形成，属于DNA嵌入剂。如多柔比星等蒽环类抗生素和放线菌素D。氟尿嘧啶（B错）为干扰核酸生物合成的药物。伊立替康（C错）为拓扑异构酶抑制剂。多西他赛（D错）及门冬酰胺酶（E错）为干扰蛋白质合成与功能的药物。